队列研究资料联系强度的主要分析指标是
A. 患病率
B. 比值比
C. 相对危险度
D. 某病病死率
E. 某病死亡人数

正确答案：C。相对危险度

解析：本题考查队列研究的分析指标。在队列研究中描述暴露与疾病联系强度的指标是相对危险度（C对ABDE错）。